颌面外科病房中有多位需换药的病人，若你是今日的值班医生，你应遵循的换药顺序是
A. 先感染，后污染，再无菌
B. 先无菌，后污染，再感染
C. 先污染，再感染，再无菌
D. 先无菌，后感染，再污染
E. 先感染，后无菌，再污染

正确答案：B。先无菌，后污染，再感染

解析：本题考查换药顺序。为了防止交叉感染，应先无菌，后污染，再感染（B对），每换完一人，都必须重新洗手，以防交叉感染。先感染，后污染，再无菌（A错）会造成换药室感染病菌，易引起患者间交叉感染。先污染，后感染，再无菌（C错）易致使无菌创口再感染。先无菌，后感染，再污染（D错）易致使污染创口再感染。先感染，后无菌，再污染（E错）易致使无菌创口、污染创口再感染。